下列方剂中含有乌梅的是
A. 平胃散
B. 止嗽散
C. 清燥救肺汤
D. 玉液汤
E. 二陈汤

正确答案：E。二陈汤

解析：二陈汤（E对）组成为半夏、橘红、白茯苓、甘草、生姜、乌梅（二陈汤用半夏陈，益以茯苓甘草成，理气和中兼燥湿，一切痰饮此方珍）；平胃散（A错）组成为苍术、厚朴、陈皮、甘草、生姜、大枣（平胃散用苍术朴，陈皮甘草四般药，除湿散满祛瘴岚，调胃诸方以此扩，又不换金正气散，即是此方加夏藿）；止嗽散（B错）组成为桔梗荆芥、紫苑、百部、白前、甘草、陈皮（止嗽散用白部菀，白前桔草荆陈研，宣肺疏风止咳痰，姜汤调服不必煎）；清燥救肺汤（C错）组成为桑叶、石膏、甘草、人参、胡麻、阿胶、麦冬、杏仁、枇杷叶（清燥救肺参草杷，石膏胶杏麦胡麻，经霜收下冬桑叶，清早润肺效堪夸）；玉液汤（D错）组成为山药、黄芪、知母、鸡内金、葛根、五味子、天花粉（玉液山药芪葛根，花粉知味鸡内金，消渴口干溲多数，补脾固肾宜气阴）。